作为消毒灭菌是否彻底的指标是
A. 荚膜
B. 芽胞
C. 鞭毛
D. 菌毛
E. 异染颗粒

正确答案：B。芽胞

解析：芽胞抵抗力强，对热力、干燥、辐射、化学消毒剂等理化因素均有强大的抵抗力，用一般的方法不易将其杀死。杀灭芽胞最可靠的方法是高压蒸汽灭菌。当进行消毒灭菌时往往以芽胞是否被杀死作为判断灭菌效果的指标。掌握“细菌的特殊结构及检查方法”知识点。